大面积烧伤病人休克期调节补液量的最可靠的临床指标为
A. 血压
B. 每小时尿量
C. 脉率
D. 口渴烦躁等临床表现
E. 中心静脉压

正确答案：B。每小时尿量

解析：尿量减少是低血容量休克的一个重要标志，成人每小时尿量低于20ml常显示血容量不足。掌握“火器伤、热烧伤”知识点。